患者久病，眼睑开合失司，下肢运动不利其病在哪经
A. 阴跷脉阳跷脉
B. 阴维脉阳维脉
C. 督脉任脉
D. 冲脉任脉
E. 阴跷脉阴维脉

正确答案：A。阴跷脉阳跷脉

解析：该题主要考察奇经八脉的生理机能。阴跷脉、阳跷脉主司下肢运动、眼睑开合（A对）。阴维脉阳维脉维系全身阴阳经脉（B错）。督脉调节阳经气血，为“阳脉之海”；反映脑、髓和肾的功能（C错）。任脉调节阴经气血，为“阴脉之海”；主胞胎（D错）。冲脉调节十二经脉气血；与女子月经及生殖功能有关（D错）。